某县医院医师张某在一个考核周期内开具不合理处方达5次以上，被认定考核不合格。县卫生计生行政部门根据《执业医师法》责令其暂停一定期限的执业活动并接受培训。该期限是
A. 3～9个月
B. 3～6个月
C. 1～6个月
D. 6～12个月
E. 1～3个月

正确答案：B。3～6个月

解析：《执业医师法》规定对考核不合格的医师，县级以上人民政府卫生行政部门可以责令其暂停执业活动3～6个月（B对），并接受培训和继续医学教育，经考核仍不合格的，则注销注册，收回医师执业证书。